患者3年来腰部时常酸痛，腰部肌肉僵硬，久坐加重，舌质淡暗，边有瘀点。针灸治疗除主穴外，应加取
A. 膈俞、次髎
B. 肾俞、足三里
C. 命门、腰阳关
D. 悬钟、太冲
E. 肾俞、太溪

正确答案：A。膈俞、次髎

解析：患者3年来腰部酸痛，肌肉僵硬，诊为腰痛，应对症取穴，可选次髎，同时符合近部取穴规律。患者舌质暗淡，边有瘀点，为瘀血之象，应对证取穴，可选用膈俞，以养血和营、理气止痛（A对）。